借助载体或酶促系统，消耗机体能量，从膜的低浓度一侧向高浓度一侧转运的药物转运方式是
A. 滤过
B. 简单扩散
C. 易化扩散
D. 主动转运
E. 膜动转运

正确答案：D。主动转运

解析：本题考查药物的转运方式。主动转运（D对）：逆浓度梯度，借助于载体或酶促系统，需要消耗能量；被动转运（A错）是物质从高浓度区域向低浓度区域的转运；简单扩散（B错）是被动转运中的一种，顺浓度梯度扩散；易化扩散（C错）为需要借助载体的被动运输，不消耗能量；膜动转运（E错）是膜凹陷吞吐，将某些物质摄入细胞内或从细胞内释放到细胞外的过程。